视交叉中央部损伤出现
A. 双眼颞侧半视野偏盲
B. 双眼同侧半视野同向性偏盲
C. 双眼鼻侧半视野偏盲
D. 同侧眼鼻侧半视野偏盲
E. 无

正确答案：A。双眼颞侧半视野偏盲

解析：视交叉中央部损伤，双眼鼻侧神经受损导致双眼颞侧半视野偏盲（A对）；一侧视神经损伤可致该侧眼视野全盲；一侧视交叉外侧部的不交叉纤维损伤，则患侧眼视野的鼻侧半偏盲；一侧视束及以后的视觉传导路（视辐射、视区皮质）受损，可致双眼病灶对侧半视野同向性偏盲。